我国规定甲类传染病报告时限在农村最多不超过
A. 1小时
B. 2小时
C. 8小时
D. 10小时
E. 12小时

正确答案：B。2小时